可通过高位结扎及剥脱术治疗的疾病是
A. 动脉硬化性闭塞症
B. 雷诺综合征
C. 下肢深静脉血栓形成
D. 血栓闭塞性脉管炎
E. 单纯性下肢静脉曲张

正确答案：E。单纯性下肢静脉曲张

解析：可通过高位结扎及剥脱术治疗的疾病是单纯性下肢静脉曲张（E对）。动脉硬化性闭塞症（A错）手术治疗常用术式包括：经皮腔内血管成形术；内膜剥脱术；旁路转流术等。雷诺综合征（B错）手术治疗可选用交感神经末梢切除术。下肢深静脉血栓形成（C错）手术治疗常用术式为Fogarty导管取栓术（发病后3～5天内）。血栓闭塞性脉管炎（D错）手术治疗常用术式包括：血栓内膜剥脱术；动脉旁路移植术等。